炸油条时，加碱和高温对营养素损失最严重的是
A. 烟酸
B. 无机盐
C. 蛋白质
D. 维生素B₁
E. 维生素B₂

正确答案：D。维生素B₁